用于内服、注射时处方药，而外用是非处方药的是
A. 对乙酰氨基酚
B. 布洛芬
C. 西咪替丁
D. 氢化可的松
E. 氢溴酸右美沙芬

正确答案：D。氢化可的松